保证运动器官血液供应的重要机制是
A. 心输出量增加
B. 循环血管增加
C. 静脉回流量增加
D. 各器官血流量的重新分配
E. 血压升高

正确答案：D。各器官血流量的重新分配